太溪穴的定位是
A. 在踝区，外踝尖与跟腱之间的凹陷处
B. 在踝区，内踝尖与跟腱之间的凹陷处
C. 在踝区，内踝下方的凹陷处
D. 在踝区，外踝下方的凹陷处
E. 在踝区，内踝与胫骨前肌腱之间的凹陷处

正确答案：B。在踝区，内踝尖与跟腱之间的凹陷处

解析：太溪穴属足少阴经，是肾之腧穴、原穴，位于足踝区，内踝尖与跟腱之间的凹陷中（B对），可治疗头痛、目眩等肾虚证；咽喉肿痛、齿痛等阴虚性五官科病证；咳嗽、气短等肺系疾患；消渴、小便频数、便秘；月经不调；腰脊痛，下肢厥冷、内踝肿痛。